膜龈联合指的是
A. 边缘龈和龈乳头之间的交界处
B. 边缘龈和附着龈之间的交界处
C. 附着龈和龈乳头之间的交界处
D. 附着龈和牙槽黏膜之间的交界处
E. 边缘龈和牙槽黏膜之间的交界处

正确答案：D。附着龈和牙槽黏膜之间的交界处

解析：本题考查膜龈联合。膜龈联合指的是附着龈和牙槽黏膜之间的交界处（D对）。附着龈的根方为牙槽黏膜，两者之间有明显的界限，称膜龈联合。膜龈联合的位置在人的一生中基本是恒定的。牙槽黏膜的上皮无角化，上皮薄，无钉突，其下方的结缔组织较为疏松，且血管丰富，因而牙槽黏膜颜色深红，移动度大。牵动唇颊，同时观察黏膜的移动度，即可确定膜龈联合的位置，从而测量附着龈的宽度。